肱二头肌长头腱起点
A. 肩胛骨盂上结节
B. 肩胛骨盂下结节
C. 肩胛骨喙突
D. 肱骨上端
E. 无

正确答案：A。肩胛骨盂上结节

解析：肱二头肌长头腱起点是肩胛骨盂上结节（A对）。